患者发热盗汗，面赤心烦，口干唇燥便结溲黄，舌红，脉数，证属阴虚火旺。治疗应首选
A. 大补阴丸
B. 增液汤
C. 六味地黄丸
D. 当归六黄汤
E. 牡蛎散

正确答案：D。当归六黄汤

解析：本题考查常见的病症的辩证、处方。题中患者发热盗汗，面赤心烦，口干唇燥便结溲黄，舌红，脉数，证属阴虚火旺。大补阴丸为补阴剂，具有滋阴降火之功效。主治阴虚火旺，潮热盗汗，咳嗽，耳鸣（A错）。增液汤主治功用，增液润燥，阳明温病，津亏便秘证，大便秘结，口渴，舌干红，脉细数或沉而无力（B错）。六味地黄丸为补益剂，具有滋阴补肾之功效。用于肾阴亏损，头晕耳鸣，腰膝酸软，骨蒸潮热，盗汗遗精，消渴（C错）。当归六黄汤为清热剂，具有清虚热，滋阴泻火，固表止汗之功效。主治阴虚火旺所致的盗汗。发热盗汗，面赤心烦，口干唇燥，大便干结，小便黄赤，舌红苔黄，脉数。临床常用于治疗甲状腺功能亢进、结核病、糖尿病、更年期综合征等属阴虚火旺者（D对）。牡蛎散为固涩剂，具有敛阴止汗，益气固表之功效。主治体虚自汗、盗汗证。常自汗出，夜卧更甚，心悸惊惕，短气烦倦，舌淡红，脉细弱。临床常用于治疗病后、手术后或产后身体虚弱、植物神经功能失调以及肺结核等所致自汗、盗汗属体虚卫外不固，又复心阳不潜者（E错）。